在病例对照研究中，病例来源于医院最大的不足是
A. 临床大夫对疾病的诊断不符合流行病学要求
B. 所得资料难以进行统计学分析
C. 信息收集偏倚大
D. 代表性差，易发生选择性偏倚

正确答案：D。代表性差，易发生选择性偏倚

解析：本题考查病例对照研究病例的选择。病例的来源主要有两种：一类是从医院选择病例，即从一所或几所医院甚至某个地理区域内全部医院的住院或门诊确诊的病例中选择一个时期内符合要求的连续病例。医院来源的病例可节省费用，合作性好，资料容易得到，而且信息较完整、准确，但不同医院接收的病人具有不同的特征，如果仅从一所医院选择病例，代表性较差（D对ABC错）。另一类是从社区人群中选择病例，即以某一地区某一时期内某种疾病的全部病例或其中的一个随机样本作为研究对象。其优点是病例的代表性好，结果推及到该人群的可信程度较高。但调查工作比较困难，且耗费人力物力较多。